必须由病人及其家属或者关系人签字同意的诊疗行为包括
A. 手术、特殊检查、特殊治疗
B. 除门诊手术以外的手术、特殊检查、特殊治疗
C. 除表皮手术以外的手术、特殊检查、特殊治疗
D. 手术、非常规性的检查、特殊治疗
E. 手术、创伤性检查、实验性治疗

正确答案：A。手术、特殊检查、特殊治疗

解析：施行手术、特殊检查或者特殊治疗时，必须征得患者同意，并应当取得其家属或者关系人同意并签字。掌握“医疗机构概述及机构执业”知识点。